修复体轴面突度过大可引起
A. 牙龈增生
B. 牙龈萎缩
C. 牙龈上皮附着破坏
D. 牙龈炎
E. 食物嵌塞

正确答案：B。牙龈萎缩

解析：本题考查牙体解剖外形凸点对龈组织的影响。修复体轴面突度过大可引起牙龈萎缩（B对）。修复体轴面与天然牙牙体轴面一样，应有适当的突度，一般认为外形在颈1/3应有保护性突度，从（牙合）面排溢出的食物顺着牙冠轴面突度滑过，恰好擦过牙龈的表面，对牙龈起生理性按摩作用。突度过大，龈组织得不到食物的按摩而导致牙龈萎缩（B对A错）。若牙冠外形平坦，食物将直接冲击牙龈，产生创伤，并进入龈沟而诱发炎症（D错）。若继续发展至牙周炎则可引起牙龈上皮附着破坏（C错）。而食物嵌塞（E错）是由于邻面接触区恢复不良，与轴面突度无关。